关于高分化肿瘤的叙述，正确的是
A. 瘤细胞极性消失
B. 瘤细胞呈巢状生长
C. 瘤细胞异型性大
D. 瘤细胞呈结节性生长
E. 瘤细胞与起源的细胞相似

正确答案：E。瘤细胞与起源的细胞相似

解析：高分化肿瘤的瘤细胞与起源的细胞相似（ E对），组织形态和功能与起源的组织相似，异型性（结构和细胞形态与相应正常组织的差异）较小（C错）。瘤细胞极性消失（A错）见于高度恶性的低分化肿瘤，如高级别乳头状尿路上皮癌。瘤细胞呈巢状生长（B错）、结节性生长（D错）均是低分化肿瘤的特点，高分化肿瘤的生长与正常组织相似。